有机磷农药中毒的机制是
A. 失活磷酸二酯酶
B. 失活单胺氧化酶
C. 失活胆碱酯酶
D. 失活腺苷酸环化酶
E. 直接激动胆碱受体

正确答案：C。失活胆碱酯酶

解析：有机磷农药属于难逆性胆碱酯酶抑制剂中的有机磷酸酯类，此类物质进入人体后，与胆碱酯酶的酯解部位结合，形成磷酰化胆碱酯酶，中毒时间过长会使酶永久失活。掌握“难逆性抗胆碱酯酶药及胆碱酯酶复活药”知识点。